佝偻病颅骨软化多发生于
A. 1～3个月
B. 3～6个月
C. 6～9个月
D. 6～12个月
E. 12个月以上

正确答案：B。3～6个月

解析：佝偻病活动期（激期）头部颅骨软化：多见于3～6个月婴儿，因此时颅骨发育最快，软化部分常发生在枕骨或顶骨中央，约6个月时颅骨软化逐渐消失。掌握“维生素D缺乏性佝偻病”知识点。